某女，42岁。患白带增多、阴部瘙痒半年，医生诊为湿热下注，处以内服中药并外用妇必舒阴道泡腾片，妇必舒阴道泡腾片的处方组成为苦参、蛇床子、大黄、百部、乌梅、硼砂、冰片、白矾、甘草，据文献报道该阴道泡腾片有抗菌消炎作用。按《中国药典》中药制剂微生物限度标准不属于妇必舒阴道泡腾片的控制菌是
A. 梭菌
B. 霉菌
C. 白色念珠菌
D. 铜绿假单胞菌
E. 金黄色葡萄球菌

正确答案：B。霉菌

解析：本题考查妇必舒阴道泡腾片的控制菌。按《中国药典》中药制剂微生物限度标准不属于妇必舒阴道泡腾片的控制菌是霉菌（B错，为本题正确答案）。按《中国药典》中药制剂微生物限度标准属于妇必舒阴道泡腾片的控制菌是梭菌（A对）、白色念珠菌（C对）、铜绿假单胞菌（D对）、金黄色葡萄球菌（E对）。